属于糖皮质激素的平喘药物是
A. 氨茶碱
B. 肾上腺素
C. 色甘酸钠
D. 异丙肾上腺素
E. 二丙酸氯地米松

正确答案：E。二丙酸氯地米松

解析：二丙酸氯地米松（E对）又名二丙酸倍氯米松，为常用的吸入性糖皮质激素类药物，有抗炎抗过敏作用，长期应用糖皮质激素治疗哮喘可以改善患者肺功能、降低气道反应性、改善症状，提高生活质量。氨茶碱（A错）为常用的支气管扩张药，对气道平滑肌有直接松弛作用，口服疗效不及静脉注射，在急性重度哮喘或哮喘持续状态时静脉注射或静脉滴注，可迅速缓解喘息与呼吸困难等症状。肾上腺素（B错）为α、β受体激动剂，皮下或肌肉注射能迅速控制支气管哮喘的急性发作，但持续时间短，不良反应较多，只适用于哮喘的急性发作。色甘酸钠（C错）属于抗过敏平喘药，主要作用是抗过敏和轻度抗炎，对速发型过敏反应具有明显的抑制作用。异丙肾上腺素（D错）为β受体激动剂，平喘作用强大，但由于他对β受体无选择性，可引起严重的心脏反应，现已少用，仅用于哮喘急性发作。